3周岁小儿按公式计算，身长体重应该是
A. 身长85厘米、体重12公斤
B. 身长96厘米、体重14公斤
C. 身长91厘米、体重12公斤
D. 身长100厘米、体重14公斤
E. 身长120厘米、体重26公斤

正确答案：B。身长96厘米、体重14公斤

解析：该题考查小儿标准身高与体重的计算。2022年中医执业医师资格考试指导用书（2022年中医执业医师考试大纲）中更正：1岁以上 体重（kg）=8+2×年龄；2岁后至12 岁儿童的身高：身高（cm）=75+7×年龄。故3周岁小儿的身高为96cm，体重为14Kg（B对）。